轻度宫颈糜烂，糜烂面积小于宫颈面积的
A. 1/4
B. 1/2
C. 1/3
D. 2/3
E. 1/5

正确答案：C。1/3

解析：宫颈糜烂面积大小将糜烂分为3度。轻度：糜烂面积小于整个宫颈面积的1/3（C对）；中度：糜烂面积占到整个宫颈面积的1/3～2/3；重度：糜烂面积达到整个宫颈面积的2/3以上。但需要注意的是，宫颈糜烂其实是生理性柱状上皮异位是阴道镜下描述子宫颈管内的柱状上皮生理性外移至子宫颈阴道部的术语，由于柱状上皮菲薄，其下间质透出而成肉眼所见的红色。过去将此种情况称为“宫颈糜烂”，并认为是慢性子宫颈炎最常见的病理类型之一。目前已明确“ 宫颈糜烂”并不是病理学上的上皮溃疡、缺失所致的真性糜烂，也与慢性子宫颈炎症的定义即间质中出现慢性炎细胞浸润并不一致。因此，“宫颈糜烂”作为慢性子宫颈炎症的诊断术语已不再恰当。子宫颈糜烂样改变只是一个临床征象，可为生理性改变，也可为病理性改变。